能增强抗凝血酶Ⅲ抗凝作用的物质是
A. 肝素
B. 蛋白质C
C. 凝血酶调制素
D. 组织因子途径抑制物
E. α2-巨球蛋白

正确答案：A。肝素